腹膜外位器官有
A. 肝
B. 胆囊
C. 子宫
D. 输尿管
E. 直肠上段

正确答案：D。输尿管

解析：肝(A错)、胆囊(B错)、子宫(C错)、直肠上段(E错)均为腹膜间位器官，输尿管(D对)为腹膜外位器官。